侧腭杆与龈缘的关系是
A. 与龈缘接触
B. 离开1～3mm
C. 离开4～6mm
D. 离开7～10mm
E. 离开11～15mm

正确答案：C。离开4～6mm

解析：本题考查侧腭杆与龈缘的关系。侧腭杆位于腭隆突两侧，离开龈缘4～6mm，保证不会对牙龈造成压迫（C对）。与牙龈接触（A错）或离开的距离偏小（1～3mm）（B错）都会对牙龈造成压迫，产生疼痛。离开的距离偏大（7～10mm）（D错）、（11～15mm）（E错）容易造成食物嵌塞且异物感强，易恶心。